先天之精来源于
A. 气血
B. 津液
C. 父母
D. 饮食水谷化生
E. 命门

正确答案：C。父母

解析：该题考查精的生成的内容。人体之精由禀受于父母的先天之精（C对）及来源于吸入清气与水谷精微的后天之精（D错）相融合而生成。精能化血，是血液生成的来源之一。精可化气，精是气的化生本源（A错）。